治疗指数（TI）指的是
A. 用来计算安全性，TI越大安全性越低。
B. TI＝LD₅₀/ED₅₀
C. TI＝LD₀₁/ED₉₉
D. TI＝LD₅₀/LD₁₀₀

正确答案：B。TI＝LD₅₀/ED₅₀

解析：本题考查治疗指数（TI）。治疗指数指半数致死量（LD₅₀）与半数有效量（ED₅₀）的比值。即TI＝LD₅₀/ED₅₀（B对ACD错）。